能引起骨髓抑制的药物是
A. 氯霉素
B. 多西环素
C. 土霉素
D. 四环素
E. 米诺霉素

正确答案：A。氯霉素

解析：氯霉素可诱发致命性不良反应（抑制骨髓造血功能），临床应用受到极大限制。掌握“四环素、多西环素及米诺环素”知识点。